原发性肺结核自然演变过程中，最常见的是
A. 自行吸收或钙化
B. 发展为肺门淋巴结结核
C. 发展为浸润型肺结核
D. 凝成“结核球”
E. 血行播散

正确答案：A。自行吸收或钙化